既平肝清热，又降压利水的药是
A. 珍珠
B. 蒺藜
C. 僵蚕
D. 珍珠母
E. 罗布麻叶

正确答案：E。罗布麻叶

解析：本题考查的是罗布麻叶的功效。既平肝清热，又降压利水的药是罗布麻叶（E对）。罗布麻叶：【功效】平肝清热，降血压，利水。珍珠（A错）：【功效】安神定惊，明目除翳，解毒敛疮，润肤祛斑。蒺藜（B错）：【功效】平肝，疏肝，祛风明目，散风止痒。僵蚕（C错）：【功效】息风止痉，祛风止痛，化痰散结。珍珠母（D错）：【功效】平肝潜阳，清肝明目，安神定惊，收湿敛疮。